当一种疗效可以延长患者生命，但不能治愈疾病，这样在人群中
A. 该病的发病率会上升
B. 该病的患病率会升高
C. 该病的发病率、患病率都会升高
D. 该病的患病率会降低
E. 该病的发病率会降低

正确答案：B。该病的患病率会升高

解析：本题考查疾病统计指标。当一种疗效可以延长患者生命，但不能治愈疾病，这样在人群中该病的患病率会升高（B对）。患病率也称现患率，表示某一时点某人群中患某病的频率。发病率表示在一定期间内，一定人群中某病新发生的病例出现的频率。